门静脉高压症主要临床表现是
A. 男性乳房发育
B. 肝掌
C. 肝病面容
D. 腹水
E. 蜘蛛痣

正确答案：D。腹水

解析：肝硬化主要表现为肝功能减退和门静脉高压两类表现。肝功能减退可表现为全身症状、消化系统症状、出血倾向、黄疸、内分泌失调等。内分泌失调表现多样，如雌激素灭活减少可表现为男性乳房发育（A错）、肝掌（B错）、蜘蛛痣（E错）等；促皮质素释放因子受抑，肾上腺皮质功能减退，促黑素细胞激素增加，呈现出肝病面容（C错）。门静脉高压症主要表现为腹水（D对）、门-腔侧支循环开放、脾功能亢进及脾大。